重型胎盘早剥与先兆子宫破裂共有的表现是
A. 剧烈腹痛
B. 合并重度妊高征
C. 跨耻征阳性
D. 子宫板状硬
E. 出现病理缩复环

正确答案：A。剧烈腹痛

解析：重型胎盘早剥表现为持续性剧烈腹痛、腰酸或腰背痛加重，先兆子宫破裂表现为下腹剧痛难忍，故剧烈腹痛是两者共有的表现（A对）。合并重度妊高征（P129-P131）（B错）、子宫板状硬（D错）是重型胎盘早剥的临床表现；跨耻征阳性（C错）、出现病理缩复环（E错）是先兆子宫破裂的临床表现，故不是共有的临床表现。